下列属小连接体是
A. 腭杆
B. 舌杆
C. 唇杆
D. 舌板
E. 增力网

正确答案：E。增力网

解析：本题考查小连接体。小连接体的作用是把义齿上的各部件，如卡环、支托等，与大连接体基托相连接，如增力网（E对）等。而腭杆（A错）、腭板、舌杆（B错）、唇/颊杆（C错）、舌板（D错）均属于大连接体。